用于治疗苯二氮䓬类药物中毒的特殊解毒剂是
A. 氟马西尼
B. 青霉胺
C. 乙氟胺
D. 纳洛酮
E. 亚硝酸钠

正确答案：A。氟马西尼

解析：本题考查中毒解救。用于治疗苯二氮䓬类药物中毒的特殊解毒剂是氟马西尼（A对）。氟马西尼用于苯二氮䓬类药物过量或中毒。青霉胺（B错）用于铜、汞、铅中毒的解毒，治疗肝豆状核变性病。乙氟胺（C错）（解氟灵）用于有机氟杀虫农药中毒。纳洛酮（D错）用于急性阿片类中毒（表现为中枢神经和呼吸抑制）及急性酒精中毒。亚硝酸钠（E错）治疗氰化物中毒。